患者，男，7岁，左上颌中切牙因外伤致牙齿嵌入牙槽窝，最恰当的处理是
A. 拔除患牙择期修复
B. 拉出嵌入的乳牙复位
C. 复位后固定
D. 拔出后再植
E. 不处理，定期复诊

正确答案：E。不处理，定期复诊

解析：为了避免根尖周组织再次损伤，不宜将牙齿拉出复位，应观察牙齿自行萌出。掌握“牙脱位”知识点。